锁骨下静脉在何处跨过第1肋
A. 后斜角肌后方
B. 前斜角肌后方
C. 中、后斜角肌之间
D. 前斜角肌前方
E. 无上述情况

正确答案：D。前斜角肌前方

解析：锁骨下静脉在前斜角肌前方（D对）跨过第1肋，至胸锁关节后方与颈内静脉汇合成头臂静脉。